调整基牙间的分散程度可以增强义齿的固位作用因为
A. 基牙越分散，各固位体间的相互制约作用越强
B. 基牙越集中，各固位体间的相互制约作用越强
C. 基牙越分散，倒凹的坡度越大
D. 基牙越集中，倒凹的坡度越大
E. 基牙越分散，义齿越稳定

正确答案：A。基牙越分散，各固位体间的相互制约作用越强

解析：调整基牙间的分散程度：基牙越分散，各个固位体亦分散，各固位体间的相互制约作用增强，固位力增强。掌握“局部义齿的设计”知识点。